某女，35岁。因银屑病口服复方青黛丸，每日3次，每次6g，服药23天后，出现乏力、恶心、腹胀、纳差。检查结果显示患者肝功能异常，临床诊断为药物性肝损伤。排除了其他因素后，停用复方青黛丸，肝功能逐步恢复正常。查阅患者病历患者2年前服用该药20天，也曾出现相同症状。复方青黛丸常见的不良反应不包括
A. 头晕
B. 腹痛腹泻
C. 肾功能损伤
D. 胃肠道出血
E. 肝功能异常

正确答案：C。肾功能损伤

解析：本题考查的是中成药的不良反应。复方青黛丸常见的不良反应不包括肾功能损伤（C错，为本题正确答案）。复方青黛丸的不良反应表现：腹泻、腹痛（B对）、肝炎、肝功能异常、头晕（A对）等；严重临床表现为药物性肝损害（E对）和胃肠出血（D对）。肾功能损伤为雷公藤制剂的不良反应表现。雷公藤制剂的不良反应表现：药物性肝炎、肾功能不全、粒细胞减少、白细胞减少、血小板减少、闭经、精子数量减少、心律失常等；严重者有肝肾功能异常、肾功能衰竭、胃出血等。